《中华人民共和国行政处罚法》规定，行政机关可以对法人或者其他组织当场作出行政处罚决定的是
A. 暂扣许可证或执照
B. 一千元以下罚款
C. 没收违法所得
D. 没收非法财物
E. 较大数额罚款

正确答案：B。一千元以下罚款

解析：本题考查简易程序。《中华人民共和国行政处罚法》规定行政机关可以对法人或者其他组织当场作出行政处罚决定的是对公民处50元以下，对法人或者其他组织处1000元以下的罚款（B对）或者警告。简易程序包括：①表明身份（执法人员应向当事人出示执法身份证件）。②确认违法事实，说明处罚理由和依据。③制作行政处罚决定书。④交付行政处罚决定书。⑤备案。暂扣许可证或执照（A错）、没收违法所得（C错）、没收非法财物（D错）属于行政处罚，不适用于简易程序。较大数额罚款（E错）适用于听证程序。